患者不能拒绝
A. 治疗
B. 公开病情
C. 手术
D. 实验
E. 遵守医院制度

正确答案：E。遵守医院制度